伦理审查需要多少人同意
A. 全部委员1/2以上通过
B. 参会委员1/2以上通过
C. 全部委员全数通过
D. 参会委员全数通过
E. 全部委员1/3以上通过

正确答案：A。全部委员1/2以上通过

解析：我国《涉及人的生物医学研究伦理审查办法》第二十三条规定：“伦理委员会作出决定应当得到伦理委员会全体委员的二分之一以上同意”（A对）。